确定中药有毒无毒的依据有
A. 归经的多少
B. 药味的多少
C. 含不含有毒成分
D. 整体是否有毒
E. 用量是否适当

正确答案：C、D、E。含不含有毒成分；整体是否有毒；用量是否适当